雷公藤除祛风湿、通经络、消肿止痛外，又能
A. 降血压
B. 杀虫解毒
C. 强筋健骨
D. 利水消肿
E. 定惊止痉

正确答案：B。杀虫解毒

解析：本题考查的是雷公藤的功效。雷公藤除祛风湿、通经络、消肿止痛外，又能杀虫解毒（B对）。雷公藤：【功效】祛风除湿，活血通络，消肿止痛，杀虫解毒。臭梧桐：【功效】祛风湿，通经络，降血压（A错）。仙茅：【功效】补肾壮阳，强筋健骨（C错），祛寒除湿。香加皮：【功效】祛风湿，强筋骨，利水消肿（D错）。蕲蛇：【功效】祛风通络，定惊止痉（E错）。